我国普遍应用的口服疫苗为
A. 卡介苗
B. 乙肝疫苗
C. OPV
D. IPV
E. 百白破混合制剂

正确答案：C。OPV

解析：本题考查各类疫苗的接种部位。OPV（C对）口服接种，糖丸剂型每次1粒。卡介苗（A错）上臂外侧三角肌中部略下处，皮内注射0.1ml。乙肝疫苗（B错）上臂外侧三角肌或大腿前外侧中部，肌内注射。IPV（D错）于上臂外侧三角肌或大腿前外侧中部，肌内注射）0.5ml。百白破混合制剂（E错）上臂外侧三角肌或臀部，肌内注射0.5ml。